防风通圣丸的主治病证有
A. 头痛咽干
B. 恶寒壮热
C. 湿疮
D. 大便秘结
E. 风疹

正确答案：A、B、C、D、E。头痛咽干；恶寒壮热；湿疮；大便秘结；风疹

解析：本题考查防风通圣丸的主治。防风通圣丸的主治病证有头痛咽干 （A对）、恶寒壮热（B对）、湿疮（C对）、大便秘结（D对）、风疹（E对）。防风通圣丸（颗粒）【功能】解表通里，清热解毒。【主治】外寒内热，表里俱实，恶寒壮热，头痛咽干，小便短赤，大便秘结，瘰疬初起，风疹湿疮。